感染根管内的主要细菌是
A. 链球菌类
B. 兼性厌氧菌
C. 专性厌氧菌
D. 真细菌类
E. 放线菌类

正确答案：C。专性厌氧菌

解析：感染根管指的是含有坏死牙髓的根管。厌氧菌，尤其是专性厌氧菌是感染根管内的主要细菌，包括类杆菌（如产黑色素杆菌和不产黑色素杆菌）、梭杆菌、真杆菌、丙酸杆菌、消化链球菌和放线菌等，都与根尖周病的发生和发展有密切关系。掌握“根尖周病概述”知识点。